下列哪一种不属于感染性发热
A. 流行性腮腺炎
B. 细菌性痢疾
C. 钩端螺旋体病
D. 药物热
E. 阿米巴脓肿

正确答案：D。药物热